妊娠早期，小腹胀痛，腰酸，阴道有少量流血者，诊断为
A. 胎漏
B. 胎动不安
C. 堕胎
D. 小产
E. 滑胎

正确答案：B。胎动不安

解析：妊娠期间出现腰酸、腹痛、小腹下坠，或伴有阴道少量流血者，称为胎动不安（B对）。妊娠期阴道少量流血，时出时止，或淋漓不断，而无腰酸、腹痛、小腹坠胀者，称为胎漏（A错）。凡妊娠12周内，胚胎自然殒堕者，为堕胎（C错）。妊娠12-28周内，胎儿已成形而自热殒堕者，称为小产（D错）。凡堕胎或小产连续发生3次或以上者，称为滑胎（E错）。